下列情形医师应当向夫妻双方说明，并提出终止妊娠的医学意见
A. 胎儿有严重缺陷的
B. 胎儿患严重遗传性疾病的
C. 可能危及孕妇生命安全
D. 危害孕妇健康
E. 以上说法均正确

正确答案：E。以上说法均正确

解析：终止妊娠医学意见　经产前诊断，有下列情形之一的，医师应当向夫妻双方说明情况，并提出终止妊娠的医学意见：①胎儿患严重遗传性疾病的；②胎儿有严重缺陷的；③因患严重疾病，继续妊娠可能危及孕妇生命安全或者严重危害孕妇健康的。掌握“母婴保健法及其实施办法”知识点。